关于炭疽芽胞杆菌叙述错误的是
A. 呈竹节状排列
B. 无氧时易形成芽胞
C. 荚膜和炭疽毒素是主要致病物质
D. 无鞭毛
E. 治疗以青霉素类为首选

正确答案：B。无氧时易形成芽胞

解析：炭疽芽孢杆菌属于革兰氏阳性粗大杆菌，在有氧条件下形成椭圆形芽孢，经培养后形成竹节样排列的长链。有毒菌株可形成角膜且无鞭毛，而且抗原分为两部分，一部分为荚膜，菌体和芽孢，另一部分为炭疽毒素复合物。掌握“动物源性细菌”知识点。